给药后易产生抗体，5天至1年内重复给药疗效可能下降，1年内不宜再次使用的溶栓药是
A. 阿替普酶
B. 瑞替普酶
C. 尿激酶
D. 链激酶
E. 降纤酶

正确答案：D。链激酶

解析：本题考查链激酶。链激酶（D对）输注后可产生抗体，在5天-1年内重复给药，其疗效可能降低，故一年内不宜重复给药。